液体药剂中的防腐剂
A. 山梨酸
B. 羟丙基甲基纤维素
C. 甲基纤维素
D. 微粉硅胶
E. 聚乙二醇 400

正确答案：A。山梨酸

解析：本题考查液体制剂常用的附加剂。山梨酸（A对）为防腐剂，常用的防腐剂包括苯甲酸与苯甲酸钠、对羟基苯甲酸酯类、山梨酸与山梨酸钾、苯扎溴铵和其它防腐剂。羟丙基甲基纤维素（B错）简称羟丙甲纤维素（HPMC），属于片剂的胃溶型包衣材料；甲基纤维素（C错）可作为水溶性软膏的基质组成成分；微粉硅胶（D错）是一种化学成分,具有良好的特性,有湿润性、粘结性、分散性、增稠性和保水性等；聚乙二醇400（E错）可用作注射用溶剂。